下列各项中属乙类传染病的是
A. 霍乱
B. 鼠疫
C. 传染性非典型肺炎
D. 风疹
E. 流行性感冒

正确答案：C。传染性非典型肺炎

解析：乙类传染病包括：传染性非典型肺炎（C对）、艾滋病、病毒性肝炎；脊髓灰质炎、人感染高致病性禽流感、麻疹、流行性出血热、狂犬病、流行性乙型脑炎、登革热、炭疽等。鼠疫（B错）和霍乱（A错）属于甲类传染病。流行性感冒（E错）、风疹（D错）属于丙类传染病。